有关胸导管的下列叙述，错误的是
A. 始于乳糜池
B. 收集左、右腰干和肠干的淋巴
C. 穿膈的食管裂孔入胸腔
D. 注入左静脉角
E. 是淋巴的主要收集管

正确答案：C。穿膈的食管裂孔入胸腔

解析：胸导管在平第12胸椎处起始于乳糜池（A对），收集左右腰干和肠干的淋巴（B对），穿过膈的主动脉裂孔进入胸腔（C错，为本题正确答案），注入左静脉角（D对），胸导管是全身最大的淋巴导管，收集全身四分之三的淋巴回流（E对）。